患者，女，20岁，心尖部听到一个舒张中期出现的先递减后递增型的隆隆样杂音，伴有第一心音增强；心律表现为节律不规则，第一心音强弱不一致，心率大于脉率现象。提示该患者的风湿性心脏瓣膜病是
A. 二尖瓣狭窄
B. 二尖瓣关闭不全
C. 二尖瓣狭窄并关闭不全
D. 二尖瓣狭窄并心房颤动
E. 二尖瓣关闭不全并心房颤动

正确答案：D。二尖瓣狭窄并心房颤动

解析：心尖部舒张中期先递减后递增型的隆隆样杂音，伴有第一心音增强，提示二尖瓣狭窄（BE错）；节律不规则，第一心音强弱不一致，心率大于脉率现象，提示心房颤动（AC错），因此该患者的风湿性心脏瓣膜病是二尖瓣狭窄并心房颤动（D对）。